下列哪种病变通常不出现蛋白尿
A. 化脓性扁桃体炎引起的高热
B. 高血压病(3级)
C. 妊娠中毒症
D. 缺血性心脏病(心绞痛发作时)
E. 慢性右心功能不全

正确答案：D。缺血性心脏病(心绞痛发作时)

解析：化脓性扁桃体炎引起的高热可出现生理性蛋白尿，妊娠中毒症、高血压病3级见于肾功异常导致的蛋白尿，慢性右心功能不全引起水肿可出现蛋白尿。